属于贝丁酸类药物，会增加脂蛋白酶活性，加速脂蛋白酶分解的药物是
A. 阿托伐他汀
B. 依折麦布
C. 普罗布考
D. 考来烯胺
E. 非诺贝特

正确答案：E。非诺贝特

解析：本题考查非诺贝特的药理作用。非诺贝特（E对）能够增加脂蛋白酶的活性，加速脂蛋白分解。